女，40岁。眼睑下垂，全身无力3年。服用吡啶斯的明有效，近两日感冒后突感胸闷，今日上午气促，口唇发绀。下列处理中，哪项是错误的
A. 保持呼吸道通畅
B. 立即停用抗胆碱酯酶药物
C. 肌注新斯的明
D. 气管切开，人工呼吸
E. 静脉补液，维持水、电解质平衡

正确答案：C。肌注新斯的明

解析：患者中年女性，眼睑下垂，全身无力3年，服用吡啶斯的明有效，考虑诊断为重症肌无力。患者近两日感冒后突感胸闷，今日上午气促，口唇发绀，说明患者已经出现呼吸肌无力的重症肌无力危象，此时最重要的是保持呼吸道通畅（A对），静脉补液维持水、电解质平衡（E对），如果这些早期治疗无效，应行气管切开，人工呼吸（D对），立即停用新斯的明等抗胆碱酯酶药物（B对）（C错，为本题正确答案）以减少气管内的分泌物（新斯的明会抑制胆碱酯酶，导致Ach降解减少，从而导致气管内分泌物增多），还需选用抗生素积极控制肺部感染。